下列药物中不宜与藜芦配伍的是
A. 黄芩
B. 黄连
C. 黄柏
D. 龙胆草
E. 沙参

正确答案：E。沙参

解析：十八反歌：本草明言十八反，半蒌贝蔹及攻乌。藻戟遂芫俱战草，诸参辛芍叛藜芦。不宜与藜芦配伍的药物包括：人参、西洋参、党参、丹参、玄参、南（北）沙参、苦参、细辛、白芍、赤芍（E对ABCD错）。